男，20岁。左腰部被刺后伤口持续溢出淡红色液体2小时。查体：P110次／分，BP95/70mmHg。左上腹有压痛，无肌紧张及反跳痛。最重要的治疗措施为
A. 立即手术探查
B. 静脉应用抗生素，观察
C. 持续导尿，观察尿量颜色变化
D. 补液抗休克治疗
E. 绝对卧床2周以上

正确答案：A。立即手术探查

解析：患者青年男性，左腰部（肾区）被刺后伤口持续溢出淡红色液体2小时，查体：P110次／分（正常60-100次/分），BP95/70mmHg（正常90-120/60-90mmHg）。左上腹有压痛，无肌紧张及反跳痛（无腹膜刺激征），说明刺伤未伤及脾脏、胃、肠、胰腺等脏器。肝脏大部分位于腹右侧，左腰部受伤一般不伤及肝脏。因此，诊断应先考虑肾损伤，应立刻手术探查（A对），进行及时处理。患者为开放性伤口，肾脏损伤，余选项中（P525）静脉应用抗生素（A错）、持续导尿，观察尿量颜色变化（C错）、补液抗休克治疗（D错）、绝对卧床2周以上（E错）均属于肾损伤的保守治疗。